能利湿退黄的药是
A. 川乌
B. 秦艽
C. 防己
D. 桑枝
E. 徐长卿

正确答案：B。秦艽

解析：本题考查的是秦艽的功效。能利湿退黄的药是秦艽（B对）。秦艽：【功效】祛风湿，舒筋络，清虚热，利湿退黄。川乌（A错）：【功效】祛风除湿，散寒止痛。防己（C错）：【功效】祛风湿，止痛，利水。桑枝（D错）：【功效】祛风通络，利水。徐长卿（E错）：【功效】祛风止痛，活血通络，止痒，解蛇毒。